牙周-牙髓联合病变治疗的原则，不包括
A. 尽快查清病源，确定主次
B. 一般来说，死髓牙先做牙髓治疗，配合一般牙周治疗
C. 不能同时牙周、牙髓治疗
D. 逆行性牙髓炎，牙周病变重且不易彻底控制炎症的可直接拔除患牙
E. 牙周病变较重且牙髓活力迟钝的患牙，应同时做牙髓治疗，以利于牙周病变的愈合

正确答案：C。不能同时牙周、牙髓治疗

解析：在不能确定的情况下，死髓牙先做根管治疗，配合牙周治疗；活髓牙则先做系统的牙周治疗和调（牙合），若疗效不佳，再视情况行牙髓治疗。掌握“牙周-牙髓联合病变”知识点。